转为慢性肝炎比例最高的是
A. 甲型肝炎病毒
B. 乙型肝炎病毒
C. 丙型肝炎病毒
D. 丁型肝炎病毒
E. 戊型肝炎病毒

正确答案：C。丙型肝炎病毒

解析：转为慢性肝炎比例最高的是丙型肝炎病毒（C对），可高达50%～85%。急性肝炎多数患者在3个月内临床康复，肝组织学恢复稍晚。甲型肝炎（A错）预后良好，较少转为慢性肝炎，病死率约为0.01%；急性乙型肝炎（B错）60%～90%可完全康复，10%～40%转为慢性或病毒携带；急性丁型肝炎（D错）重叠HBV感染时约70%转为慢性；急性戊型肝炎（E错）转为慢性肝炎的比例较丙型肝炎病毒低。